男，35岁，矿工，体重60公斤。被困井下8日，获救后口渴躁狂，体重降至55公斤，血清钠155mmol/L，应初步诊断为
A. 等渗性缺水
B. 轻度缺水
C. 中度缺水
D. 重度缺水
E. 低渗性缺水

正确答案：D。重度缺水

解析：患者被困井下8日，口渴，血清钠155mmol/L（正常值为135～145mmol/L），应诊断为高渗性缺水（AE错）。根据患者缺水后出现的症状，将高渗性缺水又分为三度：轻度缺水者除口渴外，无其他症状，缺水量为体重的2%～4%；中度缺水者有极度口渴、乏力、尿少、尿比重增加、皮肤失去弹性、眼窝下陷、常有烦躁不安等表现，缺水量为体重的4%～6%；重度缺水者除上述症状外，出现狂躁、幻觉、谵妄、昏迷，缺水量超过体重的6%。患者体重下降5公斤，失水量超过全身体重的6%，并出现躁狂（提示有神经精神症状），故应初步诊断为重度缺水（D对BC错）。本题需注意烦躁不安与狂躁的区别：烦躁不安只是兴奋性增高，还不属于精神症状，为中度缺水的临床表现，而狂躁属于神经精神症状，为重度缺水的临床表现。